下列哪种氨基酸为儿童必需的氨基酸
A. 赖氨酸
B. 组氨酸
C. 苏氨酸
D. 蛋氨酸
E. 胱氨酸

正确答案：B。组氨酸